颈内动脉的分支
A. 后交通动脉
B. 脑膜中动脉
C. 前交通动脉
D. 大脑后动脉
E. 小脑上动脉

正确答案：A。后交通动脉

解析：颈内动脉起自颈总动脉，自颈部向上至颅底，经颈动脉管进入颅腔。颈内动脉供应脑的主要分支为：大脑前动脉、大脑中动脉、脉络丛前动脉、后交通动脉（A对）。